炎症灶内组织和细胞的变性坏死，称为
A. 化生
B. 增生
C. 再生
D. 变质
E. 萎缩

正确答案：D。变质

解析：炎症灶内组织和细胞的变性坏死称为变质（D对）。化生（P9）（A错）是指一种分化成熟的细胞类型被另一种分化成熟的细胞类型所取代的过程。增生（P8）（B错）是指细胞有丝分裂活跃导致组织或器官内细胞数目增多的现象。再生（P27）（C错）是指机体出现损伤时，以损伤周围的同种细胞对缺损进行修补恢复的过程。萎缩（P5）（E错）是指已发育正常的细胞、组织或器官的体积缩小。